负责全国药品价格工作的是
A. 国家药品监督管理部门
B. 省级人民政府价格主管部门
C. 国务院价格主管部门
D. 县级人民政府价格主管部门
E. 地（市）级药品监督管理部门

正确答案：C。国务院价格主管部门

解析：本题考查药品价格管理。负责全国药品价格工作的是国务院价格主管部门（C对）。《中华人民共和国药品管理法实施条例》第四十九条规定，依法实行政府定价、政府指导价的药品，由政府价格主管部门依照《药品管理法》第五十五条规定的原则，制定和调整价格；其中，制定和调整药品销售价格时，应当体现对药品社会平均销售费用率、销售利润率和流通差率的控制。具体定价办法由国务院价格主管部门依照《中华人民共和国价格法》（以下简称《价格法》）的有关规定制定。